女，51岁。右腹股沟正中包块3年。平卧后可变小，4小时前搬重物后，包块突然增大，并出现胀痛，逐渐加重。1小时前出现右下腹阵发性绞痛。查体：表情痛苦，肠鸣音亢进，可闻及气过水声。右腹股沟下方可及3cm×3cm包块，触痛明显，无搏动感，平卧手法还纳未成功。处理疝囊后，一般将切断的腹股沟韧带修复缝合在
A. 耻骨肌筋膜上
B. 精索前方下腹外斜肌腱膜上
C. 精索后方与联合腱上
D. 精索后方与腹外斜肌腱膜上
E. 精索前方与联合腱上

正确答案：A。耻骨肌筋膜上

解析：中年女性妇女，右腹股沟正中包块3年，平卧后可变小（股疝典型表现，因脂肪堆积疝块在平卧时不能完全消失），搬重物后包块增大，出现胀痛，逐渐加重（腹压增加致使股疝发生嵌顿），查体：表情痛苦，肠鸣音亢进，可闻及气过水声，右腹股沟下方可及3cm×3cm包块，触痛明显，无搏动感，平卧手法还纳未成功（腹外疝嵌顿典型表现），根据患者的病史、临床表面体征，最可能的诊断是股疝，已发展为嵌顿性股疝，如不及时处理，会迅速发展为绞窄性疝，目前最常用的手术是Mc Vay修补法，在处理疝囊后，一般将切断的腹股沟韧带修复后缝合在耻骨肌筋膜上（A对），以关闭股环。